防暑降温常采用
A. 局部抽出式机械通风
B. 有组织全面自然通风
C. 局部通风
D. 送入式机械通风
E. 旁侧抽风

正确答案：B。有组织全面自然通风